与非意识性本体感觉有关
A. 薄束核
B. 楔束核
C. 后角固有核
D. 齿状核
E. 三叉神经中脑核

正确答案：D。齿状核

解析：非意识性本体感觉又称深感觉，由躯干和四肢意识性本体感觉和精细触觉传导通路传导。薄束核（A错）和楔束核（B错），以及后角固有核（C错）均参与躯干和四肢意识性本体感觉和精细触觉传导通路。三叉神经中脑核（E错）参与头面部的痛温觉和触压觉传导通路。只有齿状核（D对）参与非意识性本体感觉通路。